孕足月，初产妇，24岁。第二产程2小时30分钟，胎盘娩出后，有间歇性阴道流血并有血块排出，量超过500mL，查：子宫轮廓不清，首先应考虑为
A. 阴道静脉破裂
B. 凝血机制障碍
C. 胎盘残留
D. 宫颈裂伤
E. 子宫收缩乏力

正确答案：E。子宫收缩乏力

解析：患者胎盘娩出后，有间歇性阴道流血并有血块排出，量超过500mL，说明由于子宫收缩乏力，引起产后出血（E对AB错）。胎盘一般是在胎儿从产道娩出以后5—15分钟左右，最晚不超过30分钟娩出体外，此时如果出现胎盘没有完全排出而有一部分留存在子宫内部的现象被称为胎盘残留（C错）。宫颈裂伤在娩出力过强时容易发生的是子宫颈管撕裂（D错）。